在局麻手术中，普鲁卡因注射液加用少量肾上腺素后产生的结果有
A. 肾上腺素舒张血管引起血压下降
B. 普鲁卡因不良反应增加
C. 普鲁卡因吸收减少
D. 普鲁卡因作用时间延长
E. 普鲁卡因拮抗肾上腺素的作用

正确答案：C、D。普鲁卡因吸收减少；普鲁卡因作用时间延长

解析：本题考查增强作用。肾上腺素能够使用药局部的血管收缩，在局麻手术中，普鲁卡因注射液加用少量肾上腺素后产生的结果有：普鲁卡因吸收少（C对）、普鲁卡因作用时间延长（D对）、普鲁卡因不良反应减少（B错）。